下列哪种说法是正确的
A. 发病率和患病率是一样的
B. 现患率和患病率是不一样的
C. 某病发病率的分母中包括具有该病免疫力和现患病
D. 发病率指某特定时期内特定人群中新病例发生的频率
E. 患病率指特定时期内特定人群中发生某病的比例

正确答案：D。发病率指某特定时期内特定人群中新病例发生的频率